既补血又活血的药物是
A. 党参
B. 西洋参
C. 太子参
D. 当归
E. 制首乌

正确答案：D。当归

解析：当归的功效为补血活血，调经止痛，润肠通便；本品味甘而辛，即善补血，又能活血（D对）。党参的功效为补脾益肺，养血生津（A错）。西洋参的功效为补气养阴，清热生津（B错）。太子参的功效为益气健脾，生津润肺（C错）。制何首乌的功效为补肝肾，益精血，乌须发，强筋骨，化浊降脂（E错）。